哪个错误
A. 为迷走神经的一个分支
B. 全部喉肌由其支配
C. 下行于颈内动脉内侧
D. 包含有特殊内脏运动纤维和一般内脏感觉纤维
E. 管理部分喉黏膜感觉

正确答案：B。全部喉肌由其支配

解析：喉肌的主要运动神经是喉返神经而不是喉上神经（B错，为本题正确答案）。喉上神经是迷走神经在颈部最大的分支（A对），下行于颈内动脉内侧（C对），在舌骨大角处分为内、外两支。内支含一般内脏感觉纤维，管理部分喉黏膜感觉（E对）；外支含特殊内脏运动纤维（D对），支配环甲肌。